男，36岁。车祸致胸腹复合伤4天，呕血1天，共3次，每次约50～100ml。呕血前无不适症状。既往无腹痛史。呕血的原因是
A. 食管胃底静脉曲张破裂
B. 急性胃黏膜病变出血
C. 胃癌出血
D. 胃溃疡出血
E. 十二指肠溃疡出血

正确答案：B。急性胃黏膜病变出血

解析：急性胃粘膜病变是以胃粘膜发生不同程度糜烂、浅溃疡和出血为特征的病变，发生于应激状态。患者有胸腹联合伤史，处于应激状态，出现上消化道出血，考虑急性胃黏膜病变出血（B对）。食管胃底静脉曲张破裂有肝脏病史，呕血前常有腹痛等腹部症状（A错）。胃癌出血常有腹痛等腹部症状（C错）。胃溃疡：进食疼痛加剧，餐后缓解（进食增加胃酸分泌，疼痛加剧）。 十二指肠溃疡：疼痛进食缓解（进食减少胃酸流入十二指肠，疼痛减轻）（E错）。